具有甾体结构，和体内代谢生成的活性代谢物共同发挥作用的药物是
A. 氢氯噻嗪
B. 氯噻酮
C. 乙酰唑胺
D. 螺内酯
E. 阿米洛利

正确答案：D。螺内酯